肺炎球菌肺炎可出现以下体征，除了
A. 口角或鼻周单纯性疱疹
B. 肋间带状疱疹
C. 皮肤和粘膜出血点
D. 病变部位湿罗音
E. 病变部位支气管呼吸音

正确答案：B。肋间带状疱疹

解析：肺炎链球菌肺炎患者可有口角或鼻周单纯性疱疹（A对），有脓毒症者可出现皮肤和粘膜出血点（C对）。肺实变时可闻及支气管呼吸音（E对），肺炎消散期可闻及湿啰音（D对）。肋间带状疱疹（B错，为本题正确答案）是由于感染水痘带状疱疹病毒引起的，不会出现在肺炎链球菌感染的患者中。